某女，42岁。患慢性盆腔炎，症见少腹痛、腰骶痛、带下增多。治当清热除湿、化瘀止痛，宜选用的成药是
A. 妇炎平胶囊
B. 益母草胶囊
C. 千金止带丸
D. 宫血宁胶囊
E. 妇科千金片

正确答案：D。宫血宁胶囊

解析：本题考查的是宫血宁胶囊的功能。治当清热除湿、化瘀止痛，宜选用的成药是宫血宁胶囊（D对）。宫血宁胶囊【功能】凉血止血，清热除湿，化瘀止痛。妇炎平胶囊（A错）【功能】清热解毒，燥湿止带，杀虫止痒。益母草胶囊（B错）【功能】活血调经。千金止带丸（C错）【功能】健脾补肾，调经止带。妇科千金片（E错）【功能】清热除湿，益气化瘀。